农药1059、敌百虫等有机磷制剂对胆碱酯酶的抑制作用属于
A. 可逆性抑制作用
B. 竞争性抑制作用
C. 非竞争性抑制作用
D. 反竞争性抑制作用
E. 不可逆性抑制作用

正确答案：E。不可逆性抑制作用

解析：不可逆抑制作用：抑制剂与酶活性中心的必需基团形成共价结合，不能用简单透析、稀释等方法除去，这一类抑制剂称为不可逆性抑制剂，所引起的抑制作用为不可逆性抑制作用。化学毒剂，如农药1059、敌百虫等有机磷制剂即属此类。掌握“辅酶与酶促反应”知识点。